偏盲型视野缺损最常见于
A. 糖尿病性视神经乳头水肿
B. Graves病浸润性突眼
C. 嗜铬细胞瘤阵发高血压眼底出血
D. 垂体腺癌鞍上发展
E. 希恩（Sheehan）综合征垂体梗塞

正确答案：D。垂体腺癌鞍上发展

解析：偏盲型视野缺损包括双眼颞侧偏盲和双眼对侧同向性偏盲，前者多见于视交叉中部病变，常见于垂体瘤（D对）及颅咽管瘤；后者可由于视束或视辐射受损所致。垂体位于垂体窝内，上方为硬脑膜形成的鞍膈，鞍膈的前上方有视交叉和经视神经管入颅的视神经。若垂体腺癌鞍上发展最容易压迫视交叉导致偏盲型视野缺损。糖尿病性视神经乳头水肿（A错）晚期可出现视力的减退或失明，但不呈偏盲型视野缺损；Graves病浸润性突眼（九版内科学P681）（B错）常表现为眼球明显突出，眼内异物感、胀痛、畏光、流泪、复视、视力下降等，不出现偏盲型视野缺损；嗜铬细胞瘤阵发高血压眼底出血（C错）出血量不同表现不同，出血量少或位于视网膜周边部可无明显症状，若出血量多，则出现大面积或全部视野缺损，不出现偏盲；希恩（Shhan）综合征垂体梗塞（九版内科学P667）（E错）是妇女生育时大量失血导致的全垂体功能减退症，主要表现为各靶腺（性腺、甲状腺、肾上腺）功能减退，一般不出现视野缺损。